根据《中华人民共和国药品管理法》，国家对处方药和非处方药实行
A. 特殊管理制度
B. 中药品种保护制度
C. 分类管理制度
D. 药品储备制度
E. 药品保管制度

正确答案：C。分类管理制度

解析：本题考查的是药品和药品分类。根据《中华人民共和国药品管理法》，国家对处方药和非处方药实行分类管理制度（C对）。药品和药品分类：《药品管理法》规定，药品是指“用于预防、治疗、诊断人的疾病，有目的地调节人的生理机能并规定有适应症或者功能主治、用法和用量的物质，包括中药、化学药和生物制品等”。从该定义来看，我国《药品管理法》中规定的药品具有特定的内涵和外延。药品特指人用药品，不包括兽药和农药。药品的使用目的、方法有严格规定。使用目的是用于预防、治疗、诊断人的疾病，有目的地调节人的生理机能；使用方法要求必须遵循规定的适应症或者功能主治、用法和用量。根据药品的定义，药品可分为中药、化学药和生物制品三类。同时，《药品管理法》有关条文对药品进行了其他分类。《药品管理法》第四条：“国家发展现代药和传统药”；第五十四条：“国家对药品实行处方药与非处方药分类管理制度（C错）”；第六十一条：“疫苗、血液制品、麻醉药品、精神药品、医疗用毒性药品、放射性药品、药品类易制毒化学品等国家实行特殊管理（A错）的药品不得在网络上销售”。根据相关条文，药品在一定程度上还可分为现代药和传统药；处方药与非处方药；实行一般管理的药品与实行特殊管理的药品。另外，在药品注册管理中，对中药、化学药和生物制品等按药品注册类别进行分类。中药注册分类：中药创新药，中药改良型新药，古代经典名方中药复方制剂，同名同方药等。化学药注册分类：化学药创新药，化学药改良型新药，仿制药等。生物制品注册分类：生物制品创新药、生物制品改良型新药，已上市生物制品（含生物类似药）等。中药品种保护（B错）的目的和意义：根据《中药品种保护条例》，实施中药品种保护的目的是提高中药品种的质量，保护中药生产企业的合法权益、促进中药事业的发展。中药品种保护制度的实施，促进了中药质量和信誉的提升，起到了保护先进、促进老药再提高的作用；保护了中药生产企业的合法权益，使一批传统名贵中成药和创新中药免除了被低水平仿制，调动了企业研究开发中药新药的积极性；维护了正常的生产秩序，促进了中药产业的集约化、规模化和规范化生产，促进了中药名牌产品的形成和科技进步。《药品管理法》规定，国家实行药品储备制度（D错），建立中央和地方两级药品储备，发生重大灾情、疫情或者其他突发事件时，依照《中华人民共和国突发事件应对法》的规定，可以紧急调用药品。药品保管养护制度（E错）：医疗机构设置的药房，应当具有与所使用药品相适应的场所、设备、仓储设施和卫生环境，配备相应的药学技术人员，并设立药品质量管理机构或者配备质量管理人员，建立药品保管制度。定期对库存药品进行养护与质量检查，并采取必要的冷藏、防冻、控温、防潮、避光、通风、防火、防虫、防鼠、防污染等措施，保证药品质量。医疗机构应当建立药品效期管理制度。药品发放应当遵循“近效期先出”的原则。